葡萄糖注射液的含量测定方法为
A. 酸碱滴定法
B. 旋光度测定法
C. 紫外分光光度法
D. 红外分光光度法
E. 非水溶液滴定法

正确答案：B。旋光度测定法